生地、熟地同用的方剂是
A. 实脾散
B. 血府逐瘀汤
C. 当归六黄汤
D. 炙甘草汤
E. 大补阴丸

正确答案：C。当归六黄汤

解析：当归六黄二地黄，芩连芪柏共煎尝，滋阴泻火兼固表，阴虚火旺盗汗良。当归六黄汤的功用为滋阴泻火，固表止汗，主治阴虚火旺盗汗（C对）。实脾散（A错），实脾苓术与木瓜，甘草木香大腹加，草果姜附兼厚朴，虚寒阴水效堪夸。血府逐瘀汤（B错），血府当归生地桃，红花枳壳膝芎饶。柴胡赤芍甘桔梗，血化下行不作痨。炙甘草汤（D错），炙甘草汤参姜桂，麦冬生地与麻仁，大枣阿胶加酒服，虚劳肺痿效如神。大补阴丸（E错），大补阴丸知柏黄，龟板脊髓蜜成方，咳嗽咯血骨蒸热，阴虚火旺制亢阳。